肿瘤化疗恶心、呕吐，不宜选择的药物是
A. 甲氧氯普胺
B. 昂丹司琼
C. 阿托品
D. 地塞米松
E. 帕洛诺司琼

正确答案：C。阿托品